患者，女，26岁。经常于发热咽痛后出现双小腿胫前对称性红肿结节，轻微疼痛，并伴关节痛，口渴，尿黄，舌红苔薄黄而腻，脉滑数。其诊断是
A. 热疮
B. 药毒
C. 猫眼疮
D. 红斑性狼疮
E. 结节性红斑

正确答案：E。结节性红斑

解析：结节性红斑（瓜藤缠）是发生于两小腿伸侧的红色或紫红色的结节性红斑性皮肤病，多见于青年女性，以春秋、秋季发病者多。本病例患者为年轻女性，发病前有咽痛的病史，双小腿胫前对称性红肿结节，轻微疼痛，并伴关节痛，故诊断结节性红斑（E对）。热疮，是发热后或高热过程中在皮肤黏膜交界处所发生的急性疱疹性皮肤病，相当于西医的单纯疱疹，其特点是皮损为成群的水疱，有的相互融合，四周红晕，疱液清亮，破裂后露出糜烂面，逐渐干燥结痂脱落而愈，多在1周后痊愈，易于复发，自觉瘙痒及灼热感，本病例皮疹特点与之不符（A错）。药毒，亦称药疹，是指药物通过口服、注射或皮肤黏膜直接用药等途径，进入人体后所引起的皮肤或黏膜的急性炎症反应，相当于西医的药物性皮炎，其特点是发病前有用药史，并有一定的潜伏期，常突然发病，皮损形态多样，颜色鲜红，可泛发或仅限于局部，本病例皮疹特点与之不符（B错）。猫眼疮，是以红斑为主，兼有丘疹、水疱等多形性皮损的急性炎症性皮肤病，相当于西医的多形性红斑，其特点是发病急骤，皮损为丘疹、水疱等多形性损害和具有虹膜样特征的红斑，本病例皮损特点与之不符（C错）。红斑性狼疮，是一种可累及皮肤和全身多脏器的自身免疫性疾病，相当于西医的红斑狼疮，临床常见类型为盘状红蝴蝶疮和系统性红蝴蝶疮，其特点是：盘状红蝴蝶疮好发于面颊部，主要表现为皮肤损害，多为慢性局限性；系统性红蝴蝶疮除有皮肤损害外，常同时累及全身多系统、多脏器，病变呈进行性，预后较差，本病例皮疹特点与之不符（D错）。